甲状旁腺素的功能是调节血液中的
A. 钙
B. 钠
C. 镁
D. 钾
E. 锌

正确答案：A。钙

解析：甲状旁腺素（PTH）的靶器官是肾和骨，主要效应是升血钙（A对）和降血磷。PTH可促进肾远曲小管和集合管重吸收Ca²⁺，减少钙排泄，也可促进骨钙入血，升高血钙。PTH也可抑制近端和远端小管重吸收磷，促进磷排泄，降低血磷。